一般24小时内引流量低于多少时即可拔除负压引流
A. 20～30ml
B. 30～40ml
C. 50ml
D. 60ml
E. 70ml

正确答案：A。20～30ml

解析：本题考查外科引流-负压引流。引流物为异物，在达到引流目的后，应尽早拔除。污染创口或为防止积血、积液而放置的引流物，多在24～48h去除；脓肿或无效腔的引流物应放置至脓液及渗出液完全消除为止；负压引流一般在24h内引流量少于20～30ml（A对）时去除。